晚期血吸虫病患者大便检查不易发现虫卵的主要原因是
A. 成虫死亡
B. 虫卵死亡
C. 虫卵集中在肝内
D. 虫卵集中在肺内
E. 肠壁组织纤维化

正确答案：E。肠壁组织纤维化